生殖毒性试验中，受孕率等于
A. 妊娠雌性动物数/雌性动物数×100％
B. 妊娠雌性动物数/交配雌性动物数×100％
C. 交配雌性动物数/雌性动物数×100％
D. 分娩雌性动物数/交配雌性动物数×100％
E. 分娩雌性动物数/雌性动物数×100％

正确答案：B。妊娠雌性动物数/交配雌性动物数×100％